下列哪一项属于人格完整主要表现的是
A. 人格的各个结构要求不存在明显的缺陷与偏差
B. 具有清醒的自我意识，不产生自我同一性混乱
C. 以积极进取的人生观作为人格的核心
D. 有相对完整统一的心理特征
E. 以上都是

正确答案：E。以上都是

解析：人格完整表现应主要在：①人格的各个结构要求不存在明显的缺陷与偏差；②具有清醒的自我意识，不产生自我同一性混乱；③以积极进取的人生观作为人格的核心；④有相对完整统一的心理特征。掌握“心理健康概述”知识点。